男，45岁。一月前出现腹胀，无呕吐，伴发热，体温最高38℃，夜间盗汗。查体：T37.7℃，P88次/分，R16次/分，BP110/80mmHg。心肺查体未见异常，腹部揉面感，移动性浊音阳性。该患者最可能的诊断是
A. 结核性腹膜炎
B. 溃疡性结肠炎
C. 结肠癌
D. 原发性腹膜炎
E. 腹膜转移癌

正确答案：A。结核性腹膜炎

解析：男，45岁。一月前出现腹胀，无呕吐，伴发热，体温最高38℃，夜间盗汗（结核症状）。查体：T37.7℃，P88次/分，R16次/分，BP110/80mmHg。心肺查体未见异常，腹部揉面感（结核性腹膜炎的典型体征），移动性浊音阳性（腹水阳性），综上考虑诊断为结核性腹膜炎（A对）。溃疡性结肠炎（B错）的主要症状表现为腹痛和黏液脓血便，常有里急后重，排便后缓解。结肠癌（C错）也可表现为腹胀、发热、盗汗，但结肠癌以排便习惯和粪便性状的改变为最初表现，腹部触诊可触及腹部坚硬肿块。原发性腹膜炎（D错）又称自发性腹膜炎，指腹腔内无原发疾病或感染病灶存在而发生的细菌性腹膜炎，临床表现有腹膜刺激征。腹膜转移癌（E错）有原发肿瘤的临床表现。